男，45岁，酗酒后8小时出现中上腹疼痛，放射至两侧腰部，伴恶心呕吐。体检腹部有压痛、肌紧张及两侧腰腹部出现蓝棕色斑，血压75/55mmHg，脉搏110次/分。对诊断困难者应进一步采取
A. 剖腹探查
B. ERCP检查
C. 抗感染治疗下严密观察
D. 抗休克治疗
E. 腹腔穿刺

正确答案：E。腹腔穿刺

解析：患者酗酒后8小时出现中上腹疼痛，放射至两侧腰部，伴恶心呕吐，且两侧腰腹部出现蓝棕色斑即Grey-Turner征，为急性重型胰腺炎的特征性表现，故患者考虑诊断为急性重型胰腺炎，对诊断困难者可考虑腹腔穿刺做腹水淀粉酶测定（E对）。患者血压低、心率快，有休克征象，剖腹探查创伤大，故不作为首选（A错）。ERCP可加重胰腺损伤，故不作为诊断胰腺炎检查（B错）。抗感染治疗下严密观察（C错）、抗休克治疗（D错）均为该患者的治疗原则，但对明确诊断无意义。